治疗痰火郁结，瘰疬痰核，应选用
A. 石膏
B. 知母
C. 栀子
D. 天花粉
E. 夏枯草

正确答案：E。夏枯草

解析：痰火郁结，瘰疬痰核，治宜清热泻火，散结消肿。夏枯草具有清热泻火，明目，散结消肿的功效（E对）。石膏生用具有清热泻火，除烦止渴的功效，煅用具有敛疮生肌，收湿，止血的功效，无散结消肿之功（A错）。知母具有清热泻火，滋阴润燥的功效，无散结消肿之功（B错）。栀子具有泻火除烦，清热利湿，凉血解毒的功效，无散结消肿之功（C错）。天花粉具有清热泻火，生津止渴，消肿排脓的功效，无散结消肿之功（D错）。